激动时引起支气管平滑肌松弛的是
A. α受体
B. β₁受体
C. β₂受体
D. M受体
E. N₂受体

正确答案：C。β₂受体